引起慢性阻塞性肺疾病（COPD）肺动脉高压最重要的原因是
A. 肺小动脉原位血栓形成
B. 肺小动脉内膜增厚
C. 肺小动脉痉挛
D. 肺小动脉壁纤维化
E. 肺小动脉微血栓栓塞

正确答案：C。肺小动脉痉挛

解析：肺小动脉痉挛（C对）是引起慢性阻塞性肺疾病肺动脉高压最重要的原因（COPD时，机体缺氧和二氧化碳潴留，使肺血管收缩、痉挛，其中缺氧是最重要的因素，此时收缩血管的活性物质增多，肺血管收缩，血管阻力增加）。肺小动脉原位血栓形成（A错）、肺小动脉内膜增厚（B错）、肺小动脉壁纤维化（D错）、肺小动脉微血栓栓塞（E错）是肺动脉高压形成过程中肺血管阻力增加的解剖学因素，都是引起COPD肺动脉高压的原因之一，但不是最主要的原因。